罗布麻叶的主要化学成分是
A. 蒽醌类
B. 生物碱类
C. 皂苷类
D. 香豆素类
E. 黄酮类

正确答案：E。黄酮类